《中国药典》规定要做黄曲霉毒素检测的药材是
A. 地龙
B. 僵蚕
C. 龟甲
D. 蛤蚧
E. 蕲蛇

正确答案：B。僵蚕

解析：本题考查的是僵蚕的检查。《中国药典》规定要做黄曲霉毒素检测的药材是僵蚕（B对）。僵蚕【检查】杂质不得过3.0%，总灰分不得过7.0%，酸不溶性灰分不得过2.0%，水分不得过13.0%。黄曲霉毒素本品每1000g含黄曲霉毒素B₁不得过5μg，含黄曲霉毒素G₂、黄曲霉毒素G₁、黄曲霉毒素B₂和黄曲霉素B₁的总量不得过10μg。地龙（A错）【检查】杂质不得过6.0%，总灰分不得过10.0%，酸不溶性灰分不得过5.0%，水分不得过10.0%，重金属不得过30mg/kg。